成人不含红骨髓的组织是
A. 髓腔内
B. 短骨的骨松质内
C. 颅骨的板障内
D. 扁骨的骨松质内
E. 某些长骨骨端骨松质内

正确答案：A。髓腔内

解析：胎儿和幼儿的骨髓均为红骨髓， 5 岁以后，长骨骨干内的红骨髓逐渐被脂肪组织代替，呈黄色，称黄骨髓（A错，为本题正确答案）。椎骨、骼骨、肋骨、胸骨以及肱骨和股骨等长骨的骺内终生存在红骨髓，临床常选骼前上棘或骼后上棘等处进行骨髓穿刺，检查骨髓象（E对）。